疝内容物经回纳后，压住腹股沟管内环，肿块不出现的是
A. 股疝
B. 腹股沟直疝
C. 腹股沟斜疝
D. 脐疝
E. 切口疝

正确答案：C。腹股沟斜疝

解析：腹股沟斜疝包括易复性斜疝、难复性斜疝、嵌顿性斜疝、绞窄性斜疝，其中易复性疝为腹股沟区出现可复性肿块，站立或负重时出现，平卧休息或用手推送，肿块可回纳腹腔（C对）。股疝常在腹股沟韧带下方卵圆窝处出现一半球形肿块，一般约核桃大小，除部分病人在久站或咳嗽时感到患处胀痛外，无明显其他症状，尤其肥胖病人易被忽视（A错）。腹股沟直疝常见于年老体弱者。表现为患者直立时，在腹股沟内侧端，耻骨结节上外方出现一半球形肿块，肿块较软，可无任何症状。直疝囊颈宽大，平卧后疝内容物常自行复位，站立时鼓出，鸽蛋大小。直疝绝不进入阴囊，极少发生嵌顿（B错）。脐疝多属易复性疝，较常见，嵌顿少见。当啼哭、站立和用劲时，脐部膨胀出包块，直径1～2厘米，无其他症状，常在洗澡、换衣时无意中发现。多呈半球形或圆柱状，肿物顶端有一小瘢痕，是为脐痕；肿物特点为可复性，即哭闹、咳嗽、直立时肿物饱满增大，而且肿物触之较坚实；小儿安静或者家长用手按压时，肿物缩小或回纳人腹腔，伴有肠鸣音。肿物缩小或还纳后，局部留有松弛皮肤皱褶，以上为典型脐疝。成人脐疝多见于中年肥胖经产妇女。主要症状是脐部有半球形疝块，可回纳，伴有消化不良、腹部不适和隐痛。疝环通常较小，周围瘢痕组织较坚韧，较易发生嵌顿和绞窄。巨大的脐疝呈垂悬状（D错）。切口疝临床常见的切口疝主要有3种类型：普通切口疝、腹腔镜术后戳孔疝和腹部暂时关闭术形成的切口疝，后者多发生于腹腔间隙综合征的病例，如肠外瘘后切口裂开的病人，由于不能及时二期缝合，皮肤爬行覆盖肠管切口自行愈合所致（E错）。